艾滋病患者隐球菌性脑膜炎首选
A. 灰黄霉素
B. 两性霉素
C. 酮康唑
D. 氟康唑
E. 制霉菌素

正确答案：D。氟康唑